可致血钾升高的抗高血压药包括
A. 福辛普利
B. 氨苯蝶啶
C. 依那普利
D. 氢氯噻嗪
E. 螺内脂

正确答案：A、B、C、E。福辛普利；氨苯蝶啶；依那普利；螺内脂

解析：本题考查引起血钾升高的药物。可致血钾升高的抗高血压包括：留钾利尿剂、醛固酮受体拮抗剂、肾素抑制剂、ACEI类、血管紧张素Ⅱ受体阻断剂。福辛普利（A对）、依那普利（C对）属于ACEI类。氨苯蝶啶（B对）属于留钾利尿剂。螺内酯（E对）属于醛固酮受体拮抗剂。它们均可导致血钾升高。氢氯噻嗪（D错）属于噻嗪类利尿剂,会导致血钾降低。